以下关于全冠固位的说法哪项是错误的
A. 全冠固位力主要来自于摩擦力和粘接力、约束力
B. 摩擦力是最主要的固位力
C. 摩擦力大小与修复体与预备体的密合度有关
D. 全冠的（牙合）面形态与固位有关
E. 预备体的颊舌径与固位无关

正确答案：E。预备体的颊舌径与固位无关

解析：本题考查牙体缺损修复体的固位原理。预备体的颊舌径与固位有关（E错，为本题的正确答案），颊舌径越大，全冠获得的粘着力也越大。使全冠获得固位的固位力有约束力、摩擦力和粘接力，其中全冠固位力主要来自于摩擦力和粘接力（A对）。摩擦力是全冠最主要的固位力（B对）。摩擦力大小与修复体与预备体的密合度有关（C对），二者之间越密合，摩擦力越大。另外，全冠的（牙合）面形态与固位有关（D对），（牙合）面的面积越大，粘接表面积越大，越能获得较大的粘着力。